男，53岁，胃溃疡病史7年，近半月来症状加重，1小时前突发穿孔，且全腹症状逐渐加重。最佳治疗方法是
A. 非手术治疗
B. 穿孔修补术
C. 常规胃大部切除术
D. 全胃切除术
E. 高选择性迷走神经切断术

正确答案：B。穿孔修补术

解析：中年男性患者，胃溃疡穿孔1小时，全腹症状逐渐加重，最佳的治疗方法是常规穿孔修补（B对）。对于溃疡穿孔不超过24小时、腹腔污染不重的患者，可选择手术治疗，胃大部切除术可一次性解决穿孔和溃疡两个问题，故常作为首选治疗方法。患者症状有加重趋势，故不宜选择非手术治疗（A错）。胃大切术（C错）后仍需正规的抗溃疡药物治疗，因此不作为最佳治疗方法。全胃切除术（D错）由于术后并发症较多，现已较少使用。高选择性迷走神经切断术（E错）主要用于治疗十二指溃疡，不适用于急性穿孔的患者。